属于G-蛋白偶联受体的是
A. 胰岛素受体
B. 甲状腺激素受体
C. β受体
D. N受体
E. 表皮生长因子受体

正确答案：C。β受体

解析：本题考查受体的类型。M胆碱受体、肾上腺素受体（C对）、多巴胺受体、5-HT受体、前列腺素受体以及一些多肽类受体等均属于G-蛋白偶联受体。